患者，男，59岁，诊断为2型糖尿病，因口服降糖药疗效欠佳，给予预混胰岛素30R注射液。关于该患者用药教育的说法，错误的是
A. 应警惕发生低血糖，提醒患者随身携带木糖醇糖果
B. 未开启的胰岛素制剂应冷藏保存，冷冻后不可再使用
C. 胰岛素笔芯启用后不宜冷藏保存
D. 使用前应缓慢摇匀，确保给药剂量准确
E. 注射时应变换部位，两次注射点要间隔2cm以上

正确答案：A。应警惕发生低血糖，提醒患者随身携带木糖醇糖果

解析：本题考查糖尿病患者用药教育。木糖醇对血糖没有纠正作用（A错，为本题正确答案）。一旦出现低血糖，立即口服葡萄糖水、糖块、巧克力、甜点或静脉给予葡萄糖注射液。注射胰岛素时的注意事项：（1）使用前应缓慢摇匀，确保给药剂量准确（D对）。（2）每次注射时应变换注射部位，两次注射点要间隔2cm（E对）。（3）未开启的胰岛素应冷藏保存，冷冻后的胰岛素不可再应用（B对）。（4）使用中的胰岛素笔芯不宜冷藏（C对），可与胰岛素笔一起使用或随身携带。